多西环素的药理作用是
A. 对病毒感染有效
B. 对念珠菌属的细菌感染有效
C. 杀灭结核分枝杆菌
D. 抑制二氢蝶酸合酶活性
E. 对立克次体感染有效

正确答案：E。对立克次体感染有效

解析：多西环素是第二代四环素类抗生素，对立克次氏体感染为首选药物（E对），其对病毒、真菌念珠菌属、结核分枝杆菌均无效（ABC错）。抑制二氢蝶酸合酶活性（D错）的是磺胺类药物的作用机制。